并联试验可以提高诊断方法的
A. 特异度
B. 灵敏度
C. 约登指数
D. 一致性
E. 诊断准确性

正确答案：B。灵敏度

解析：本题考查并联试验的特点。并联试验，也称平行试验，即全部筛检试验同时平行开展，任何一项筛检试验结果阳性就可判定为阳性。该方法的优点是可以弥补两种方法灵敏度都不足的问题，提高筛查整体的灵敏度（B对ACDE错），但会降低特异度。